与青年人相比，老年人应用后敏感性增高易引起“晨起跌倒”的药物是
A. 美洛西林
B. 地西泮
C. 沙美特罗
D. 克伦特罗
E. 罗红霉素

正确答案：B。地西泮

解析：本题考查镇静催眠药地西泮。地西泮（B对）可致人体的平衡功能失调，老年人服用本类药后极易跌倒和受伤；美洛西林（A错）不良反应少见；沙美特罗（C错）用药过量会导致肾上腺功能抑制；克伦特罗（D错）不良反应为肌肉振颤、心慌、头疼、恶心，对高血压、心脏病、甲亢等患者危害更大，严重的可导致死亡；罗红霉素（E错）的不良反应为胃肠道反应、皮疹等。